慢性风湿性心脏病发生栓塞最常见的病因是
A. 二尖瓣狭窄并发右心衰竭
B. 二尖瓣狭窄并发肺部感染
C. 二尖瓣狭窄并发肺水肿
D. 二尖瓣狭窄并发房颤
E. 二尖瓣狭窄并发感染性心内膜炎

正确答案：D。二尖瓣狭窄并发房颤

解析：20%的二尖瓣狭窄患者可发生体循环栓塞，其中80%伴房颤（D对），房颤并发体循环栓塞的危险性甚大，栓子来自左心房，常在左心耳部，因血流瘀滞、心房失去收缩力所致。二尖瓣狭窄并发右心衰竭（A错）、二尖瓣狭窄并发肺部感染（B错）、二尖瓣狭窄并发肺水肿（C错）和二尖瓣狭窄并发感染性心内膜炎（E错）发生栓塞较少见。